进行统计描述可采用的方法是
A. 计算统计量和绘制统计图
B. 计算统计量和编制统计表
C. 计算统计量
D. 绘制统计图
E. 计算统计量、绘制统计图和编制统计表

正确答案：E。计算统计量、绘制统计图和编制统计表